鉴别水杨酸及其盐类，最常用的试液是
A. 碘化钾
B. 碘化汞钾
C. 三氯化铁
D. 硫酸亚铁
E. 亚铁氰化钾

正确答案：C。三氯化铁

解析：本题考查鉴别。鉴别水杨酸及其盐类，最常用的试液是三氯化铁（C对）。水杨酸的水溶液加三氯化铁试液，即生成紫堇色配位化合物。碘化钾（A错）用作制有机化合物及制药原料，医疗上用于防治甲状腺肿和甲状腺机能亢进的手术前准备，也可用作祛痰药。碘化汞钾（B错）用作分析试剂、杀菌剂和清毒剂，也用于纳氏试剂制备。硫酸亚铁（D错）用于治疗缺铁性贫血症；还可以作为局部收敛剂及补血剂，可用于子宫肌瘤引起的慢性失血。亚铁氰化钾（E错）溶液跟铁的盐溶液反应生成普鲁士蓝沉淀，可用于钯、银、锇、铀的滴定分析。